患者，女，44岁。右足第3及第4趾缝间潮湿，糜烂，覆以白皮，渗液较多，伴有剧烈瘙痒。诊断为糜烂型脚湿气，外治应首选
A. 一号癣药水
B. 复方土槿皮酊
C. 青黛膏
D. 雄黄膏
E. 红油膏

正确答案：D。雄黄膏

解析：脚湿气，相当于西医的足癣，分为水泡型、糜烂型和脱屑型，糜烂型其特点是发生于趾缝间，尤以3、4趾间为多见，表现为趾间潮湿，皮肤浸渍发白，将白皮除去后，基底呈鲜红色，剧烈瘙痒，往往搓至皮烂疼痛、渗流血水方止，本病例明确诊断为糜烂型脚湿气，糜烂型外治可选用1:1500高锰酸钾溶液、3%硼酸溶液、二矾汤或半边莲60g煎汤待温，浸泡15分钟，次以雄黄膏或皮脂膏外搽（D对）。1号癣药水和复方土槿皮酊用于水泡型（AB错）。青黛膏，用于有脓疱者（C错）。红油膏，具有防腐生肌的作用，用于溃疡不敛（E错）。